气管颈段的层次前方由浅入深依次为
A. 皮肤、颈浅筋膜、颈深筋膜浅层、颈深筋膜中层
B. 皮肤、颈深筋膜浅层、颈浅筋膜、颈深筋膜中层
C. 皮肤、颈浅筋膜、颈深筋膜中层、颈深筋膜浅层
D. 颈深筋膜中层、颈浅筋膜、颈深筋膜浅层、皮肤
E. 颈深筋膜中层、颈深筋膜浅层、颈浅筋膜、皮肤

正确答案：A。皮肤、颈浅筋膜、颈深筋膜浅层、颈深筋膜中层

解析：气管颈段的层次前方由浅入深依次为：①皮肤；②颈浅筋膜；③颈深筋膜浅层；④颈深筋膜中层及其包被的胸骨舌骨肌和胸骨甲状肌。掌握“气管颈段、颈动脉三角的解剖特点及临床应用”知识点。